根据《国务院关于改革药品医疗器械审评审批制度的意见》，关于仿制药与原研药品关系的说法，错误的是
A. 应具有相同的活性成分
B. 质量与疗效一致
C. 具有生物等效性
D. 应具有相同的处方工艺

正确答案：D。应具有相同的处方工艺

解析：本题考查的是仿制药的注册要求。仿制药不强调处方工艺与原研药品一致（D错，为本题正确答案）。仿制药注册要求：仿制药是指仿制已上市原研药品的药品，分为两类，一是仿制境外已上市境内未上市原研药品，二是仿制境内已上市原研药品。仿制药要求与原研药品质量和疗效一致。如果已上市药品的原研药品无法追溯或者原研药品已经撤市的，建议不再申请仿制；如坚持提出仿制药申请，原则上不能以仿制药的技术要求予以批准，应按照新药的要求开展相关研究。仿制药要求与原研药品具有相同的活性成分（A对）、剂型、规格、适应症、给药途径和用法用量，不强调处方工艺与原研药品一致，但强调仿制药品必须与原研药品质量和疗效一致（B对）。申请注册的仿制药没有达到与原研药质量和疗效一致的，不予批准。《关于药品注册审评审批若干政策的公告》（2015年第230号）规定，仿制药按照与原研药质量和疗效一致的原则受理和审评审批。其中，对已在中国境外上市但尚未在境内上市药品的仿制药注册申请，应与原研药进行生物等效性（C对）研究并按国际通行技术要求开展临床试验，所使用的原研药由企业自行采购，向国家药品监督管理局申请一次性进口；未能与原研药进行对比研究的，应按照创新药的技术要求开展研究。